患者，男，50岁。半年来经常突发胸骨后疼痛，有窒息感，持续1～5分钟，休息后迅速缓解，心电图示ST段下移及T波倒置。应首先考虑的是
A. 稳定型劳累性心绞痛
B. 初发劳累性心绞痛
C. 恶化型劳累性心绞痛
D. 自发性心绞痛
E. 急性心肌梗死

正确答案：A。稳定型劳累性心绞痛

解析：患者中年男性，半年来经常突发胸骨后疼痛，有窒息感，持续1～5分钟，休息后迅速缓解，心电图示ST段下移及T波倒置，为典型的稳定型心绞痛的表现（A对）。初发劳累性心绞痛通常在首发症状1～2个月内发生，很轻的体力活动可诱发（B错）。恶化型劳累性心绞痛在相对稳定的劳力性心绞痛基础上心绞痛逐渐增强，疼痛更剧烈，持续时间更长（C错）。自发性心绞痛，心绞痛发作与体力或脑力负荷引起心肌需氧量增加无明显关系，而与冠状动脉血流贮备量减少有关，为心肌一过性缺血所致（D错）。急性心肌梗死休息或舌下含服硝酸甘油不能缓解（E错）。